LD₀是指
A. 绝对致死剂量
B. 最小致死剂量
C. 最大耐受剂量
D. 半数致死剂量

正确答案：C。最大耐受剂量

解析：本题考查LD₀。LD₀即最大耐受剂量（C对ABD错），指一组受试实验动物中，不引起动物死亡的最大剂量。